某女，48岁，平素喜食辛辣，烦躁易怒，进来胃脘灼痛，泛酸嘈杂，口干口苦，舌红苔薄黄，脉弦数。治疗应选用的中成药是
A. 加味左金丸
B. 沉香舒气丸
C. 附子理中丸
D. 枳实导滞丸
E. 香砂养胃丸

正确答案：A。加味左金丸

解析：本题考查胃痛的辨证论治。患者为胃痛之肝胃郁热证，治疗应选用的中成药是加味左金丸（A对）。胃痛之肝胃郁热证【症状】烦躁易怒，胃脘灼痛，泛酸嘈杂，口干口苦，舌红苔薄黄，脉弦数。【中成药应用】常用中成药：加味左金丸。胃痛之肝气犯胃证【症状】胃脘胀痛，痛连两胁，遇烦恼则痛作或痛甚，嗳气、矢气则舒，脘闷嗳气，善太息，大便不畅。舌淡红，苔薄白，脉弦。【中成药应用】常用中成药：沉香化气丸、朴沉化郁丸、舒肝健胃丸、舒肝和胃丸（大蜜丸）、调胃舒肝丸。合理用药指导：不建议将沉香化气丸、沉香舒气丸（B错）、朴沉化郁丸、舒肝健胃丸、舒肝和胃丸、调胃舒肝丸、越鞠保和丸、气滞胃痛颗粒中的任意两种或多种同时使用，因皆属重复用药。口疮之脾肾阳虚证【症状】口疮疼痛较轻，久难愈合，伴倦怠乏力，腰膝或少腹以下冷痛，小便清；检查见口疮色白或暗，周边淡红或不红。舌淡，苔白，脉沉迟。【方剂应用】基础方剂：附子理中丸（C错）。泄泻之食滞肠胃证【症状】腹痛肠鸣，泻下粪便臭如败卵，泻后痛减，泻下伴有不消化食物，脘腹胀满，嗳腐吞酸，不思饮食。舌淡红，苔垢浊或厚腻，脉滑实。【中成药应用】常用中成药：加味保和丸、枳实导滞丸（D错）、和中理脾丸。香砂养胃丸（E错）为温里剂，具有温中和胃之功效。主治胃阳不足、湿阻气滞所致的胃痛、痞满，症见胃痛隐隐、脘闷不舒、呕吐酸水、嘈杂不适、不思饮食、四肢倦怠。